既补血调经，又止血的成药是
A. 逍遥丸
B. 当归丸
C. 止血片
D. 七制香附片
E. 妇康宝口服液

正确答案：E。妇康宝口服液